患者，女，52岁，因“闭经1年，潮热、情绪波动、严重失眠半年”就诊，临床诊断为“更年期综合征”。拟给予的药物治疗方案为：戊酸雌二醇片，每日1次，每次1mg；醋酸甲羟孕酮片，每日1次，每次2mg。患者在治疗过程中，应立即停药的情形是
A. 突破性出血
B. 乳房触痛或增大
C. 白带增多
D. 体重增加
E. 糖耐量异常

正确答案：A。突破性出血

解析：本题考查雌激素不良反应。偶见乳房触痛或增大、白带增多、不规则阴道出血、点滴出血，突破性出血、长期出血不止或闭经、性欲改变、胆汁淤积型黄疸、肝脏氨基转移酶AST及ALT升高，除突破性出血（A对）需停药外，一般不需停药。